某幼儿园有200名儿童，近一周内有30名儿童患病，并且有相似的症状。这种情况称之为
A. 散发
B. 暴发
C. 流行
D. 集聚
E. 传染

正确答案：B。暴发

解析：暴发是指在一个局部地区或集体单位中，短时间内，突然出现大量相同病人的现象。如托幼机构的麻疹、手足口、腮腺炎等疾病的暴发。题目中的幼儿园属于集体单位，且短时间（一周）出现很多（30名）症状相似的病人，所以是这种情况为暴发（B对）。